结构为去甲睾酮的衍生物，具有蛋白同化激素样作用的药物是
A. 苯丙酸诺龙
B. 雌二醇
C. 炔雌醇
D. 雌酮
E. 炔诺酮

正确答案：A。苯丙酸诺龙

解析：本题考查苯丙酸诺龙的结构及药理作用。苯丙酸诺龙（A对）为去甲睾酮的衍生物，可显著降低雄性激素作用，提高蛋白同化作用。